过敏性皮炎患者常表现为
A. 血红蛋白减少
B. 嗜酸性粒细胞增多
C. 中性粒细胞增多
D. 红细胞增多
E. 血小板增多

正确答案：B。嗜酸性粒细胞增多

解析：本题考查血常规检查。过敏性皮炎患者常表现为嗜酸性粒细胞增多（B对）。嗜酸性粒细胞增多：①过敏性疾病：支气管哮喘、荨麻疹、药物性皮疹、血管神经性水肿、食物过敏、血清病、过敏性肺炎等。②皮肤病与寄生虫病：牛皮辦、湿疹、天疱疮、疱疹样皮炎、真菌性皮肤病、肺吸虫病、钩虫病、包虫病、血吸虫病、丝虫病、绦虫病等。③血液系统疾病：慢性粒细胞白血病、嗜酸性粒细胞白血病等。④药物：应用头孢拉定、头孢氨苄、头孢呋辛钠、头孢哌酮等抗生素。⑤恶性肿瘤：某些上皮性来源肿瘤如肺癌等。⑥传染病：猩红热。⑦其他：风湿性疾病、肾上腺皮质功能减退症等。血红蛋白减少（A错）常见于缺铁性贫血。中性粒细胞增多（C错）见于急性感染、糖尿病酮症酸中毒、汞中毒、白血病、急性大出血等。红细胞增多（D错）见于慢性肺心病、肺气肿、高原病和肿瘤（肾癌、肾上腺肿瘤）。血小板增多（E错）见于慢性粒细胞白血病、真性红细胞增多症、急性感染、急性溶血等。